大脑后动脉叙述错误的是
A. 起自椎动脉
B. 绕大脑脚向后走行
C. 分为皮质支和中央支
D. 皮质支分布于颞叶和枕叶
E. 中央支分布于大部分间脑

正确答案：A。起自椎动脉

解析：大脑后动脉起自基底动脉（A错，为本题正确答案）。